乙酰胆碱与受体的作用，形成的主要键合类型是
A. 共价键
B. 氢键
C. 离子－偶极和偶极－偶极相互作用
D. 范德华引力
E. 疏水性相互作用

正确答案：C。离子－偶极和偶极－偶极相互作用

解析：本题考查药物与生物大分子相互作用的方式。偶极-偶极相互作用（C对）在羰基类化合物中较常见，如乙酰胆碱和受体的作用。共价键（A错）是指两个或两个以上的原子通过共用电子对形成的化学键。氢键（B错）是药物分子中含有孤对电子的O、N、S等原子和与非碳的杂原子以共价键相连的氢原子之间形成的弱化学键。范德华引力（D错））一般指分子间作用力，即存在于中性分子或原子之间的一种弱碱性的电性吸引力。疏水性相互作用（E错）是通过疏水物的疏水基与水相互排斥作用而发生的、弱的相互作用。